通过内心信念来实现的医德是
A. 自我评价
B. 社会评价
C. 医院制度
D. 国家规范
E. 科室评比

正确答案：A。自我评价

解析：在实践中，医德评价的方式是多种多样的，总括起来说主要有三种，即社会舆论、传统习俗和内心信念。对行为主体个人来说，前两种方式都是外在的客观评价，而通过内心信念来实现的医德是自我评价（A对）。